卫生行政部门收到再次鉴定申请，处理时间为
A. 7日
B. 10日
C. 15日
D. 20日
E. 30日

正确答案：A。7日

解析：当事人对首次医疗事故技术鉴定结论有异议，申请再次鉴定的，卫生行政部门应当自收到申请之日起7日内交由省、自治区、直辖市地方医学会组织再次鉴定。掌握“医疗事故行政处理、监督与法律责任”知识点。